在鉴别肠道致病菌和非致病菌的单糖发酵试验中，具有鉴别意义的单糖是
A. 葡萄糖
B. 麦芽糖
C. 蔗糖
D. 菊糖
E. 乳糖

正确答案：E。乳糖